小胃癌的定义是指癌灶直径小于
A. 2.0cm
B. 0.1cm
C. 0.5cm
D. 1.5cm
E. 1.0cm

正确答案：E。1.0cm

解析：胃癌可分为早期胃癌和进展期胃癌。早期胃癌指病变仅局限于黏膜或黏膜下层，不论病灶大小或有无淋巴结转移，其中癌灶直径小于1.0cm的胃癌称为小胃癌（E对）。癌灶直径小于0.5cm称为微小胃癌。